目前推荐的绝经期激素补充治疗的窗口期是
A. 绝经后10年之内或60岁以前
B. 大于60岁
C. 绝经后5年之内
D. 绝经后15年之内或大于60岁
E. 绝经后20年之内

正确答案：A。绝经后10年之内或60岁以前

解析：本题考查绝经期激素补充治疗的窗口期。目前推荐的绝经期激素补充治疗的窗口期，一般为绝经10年之内或60岁之前（A对）。